根据《深化医药卫生体制改革的意见》规定，我国要加快建立药品供应保障体系，保障人民群众安全用药。药品供应保障体系的基础是
A. 新药创新体系
B. 药品集中招标采购制度
C. 中西药并重
D. 国家基本药物制度
E. 药品分类管理

正确答案：D。国家基本药物制度

解析：本题考查的是基本药物制度的定义与组成要素。根据《深化医药卫生体制改革的意见》规定，我国要加快建立药品供应保障体系，保障人民群众安全用药。药品供应保障体系的基础是国家基本药物制度（D对）。基本药物制度的定义与组成要素：基本药物的概念于1975年首次由世界卫生组织提出，基本药物是指最重要的、基本的、不可缺少的、满足人民所必需的药品。我国从1979年开始引入“基本药物”的概念。2009年，通过《关于建立国家基本药物制度的实施意见》（卫药政发〔2009〕78号）等文件对基本药物的含义作了进一步的界定，明确了国家基本药物制度的内涵。《药品管理法》第九十三条明确规定；“国家实行基本药物制度，遴选适当数量的基本药物品种，加强组织生产和储备，提高基本药物的供给能力，满足疾病防治基本用药需求。”根据《基本医疗卫生与健康促进法》对基本药物的定义，基本药物是指满足疾病防治基本用药需求，适应现阶段基本国情和保障能力，剂型适宜，价格合理，能够保障供应，可公平获得的药品。国家基本药物制度是对基本药物的遴选、生产、流通、使用、定价、报销、监测评价等环节实施有效管理的制度。国家基本药物制度是为维护人民群众健康、保障公众基本用药权益而确立的一项重大国家医药卫生政策，与公共卫生、医疗服务、医疗保障体系相衔接，是国家药物政策的核心和药品供应保障体系的基础。